岗位责任制是为了
A. 防止药物滥用
B. 保证分装准确无误
C. 保证发药正确率
D. 保证药品质量和发药剂量
E. 考核审查工作质量和效率处方调配的有关管理制度中

正确答案：E。考核审查工作质量和效率处方调配的有关管理制度中